去甲肾上腺素对心血管的作用主要是
A. 舒张血管
B. 升高血压
C. 心率加快
D. 强心
E. 增大脉压

正确答案：B。升高血压